患者，女，26岁。下肢弛缓无力1年余，肌肉明显萎缩，功能严重受限，并感麻木，发凉，腰痛，头晕。舌红少苔，脉细数。治疗应选取何经穴为主
A. 督脉经
B. 太阳经
C. 阳明经
D. 少阳经
E. 厥阴经

正确答案：C。阳明经

解析：本题考查常见的病症的辩证、处方。该患者主证为下肢弛缓无力1年余，肌肉明显萎缩、功能严重受限，并感麻木，由此可诊断为痿证。阳明经多血多气，选上、下肢阳明经穴位，可疏通经络、调理气血（C对）。针刺太阳经穴可用于治疗中风偏瘫（B错）。针刺督脉经穴可用于治疗腰痛,腹痛,泄泻,痢疾,脱肛等（A错）。针刺少阳经穴可用于面瘫、偏头疼等病症（D错）。针刺厥阴经穴可用于治疗前列腺增生等病症（E错）。